未婚女，28岁。闭经2年。肛诊：子宫正常大小，孕激素试验阴性，下一步最佳检查方法是
A. 垂体兴奋试验
B. 基础体温测定
C. 染色体检查
D. 激素水平测定
E. 雌激素试验

正确答案：E。雌激素试验

解析：青年未婚女性患者，闭经2年（继发性闭经是指正常月经建立后月经停止6个月以上），肛诊：子宫正常大小（排除妊娠可能）。综合该患者的病史、体查，该患者诊断考虑为继发性闭经。该患者孕激素试验阴性，下一步最佳检查方法是雌激素试验（E对），根据是否出血判断是否为子宫性闭经。激素水平测定（D错）应在雌激素试验有出血后（排除子宫因素）进行，以判断是否为卵巢性闭经。垂体兴奋试验（A错）应在激素水平测定FSH、LH正常或偏低后进行，以确定是否为垂体性闭经。基础体温测定（B错）可用于监测是否排卵。染色体检查（C错）可用于原发性闭经中的核型分析。